蛋白质合成后经化学修饰的氨基酸是
A. 半胱氨酸
B. 羟脯氨酸
C. 甲硫（蛋）氨酸
D. 丝氨酸
E. 酪氨酸

正确答案：B。羟脯氨酸